参与构成翼点的骨是
A. 顶骨、额骨、蝶骨、颞骨
B. 枕骨、额骨、筛骨、颞骨
C. 顶骨、颞骨、枕骨、蝶骨
D. 额骨、筛骨、腭骨、颧骨
E. 无

正确答案：A。顶骨、额骨、蝶骨、颞骨

解析：颞窝前下部较薄，在额、顶、颞、蝶骨汇合处最为薄弱，此处常构成 H 形的缝，称翼点，故翼点是由顶骨、额骨、蝶骨、颞骨构成（A对）。